肠结核的好发部位是
A. 十二指肠多见
B. 全消化道均可发生，呈节段性跳跃性分布
C. 回盲部多见
D. 空肠多见
E. 从直肠向近段结肠呈逆性分布

正确答案：C。回盲部多见

解析：肠结核由结核分枝杆菌引起，该菌易侵犯淋巴组织，而回盲部淋巴组织丰富，并且含有结核杆菌的肠内容物在回盲部停留较久，增加了局部黏膜的感染机会，所以肠结核病变主要位于回盲部（C对）。另外，肠结核也可累及空肠（D错）、结肠和直肠。十二指肠（A错）是十二指肠溃疡的好发部位。全消化道均可发生，呈节段性跳跃性分布（B错）是克罗恩病的典型特征（P377）。从直肠向近段结肠呈逆性分布（E错）是溃疡性结肠炎的特点（P373）。